行政机关作出较大数额罚款的行政处罚决定前，当事人有权要求进行的程序是
A. 简易程序
B. 一般程序
C. 听证程序
D. 复议程序
E. 处理程序

正确答案：C。听证程序

解析：本题考查的是行政处罚的程序。行政机关作出较大数额罚款的行政处罚决定前，当事人有权要求进行的程序是听证程序（C对）。行政处罚的程序：1.行政处罚的决定及其程序：公民、法人或者其他组织违反行政管理秩序的行为，依法应当给予行政处罚。行政机关在作出行政处罚决定之前，应当告知当事人作出行政处罚决定的事实、理由及依据，并告知当事人依法享有的权利。行政处罚决定程序有2大类。（1）简易程序（A错）（当场处罚程序）：当违法事实清楚、有法定依据、拟作出数额较小的罚款（对公民处50元以下，对法人或者其他组织处1000元以下的罚款）或者警告时，可以适用简易程序，当场处罚。（2）一般程序（B错）（普通程序）。2.听证程序：行政机关作出责令停产停业、吊销许可证或者执照、较大数额罚款等行政处罚决定之前，应当告知当事人有要求举行听证的权利；当事人要求听证的，行政机关应当组织听证。当事人不承担行政机关组织听证的费用。行政复议程序（D错）：行政复议程序分为申请、受理、审理、决定和执行五个阶段。